下列哪项不是“听”的技巧
A. 全神贯注倾听
B. 不做无关的动作
C. 不任意打断服务对象的谈话
D. 用非语言交流方式给予服务对象及时反馈
E. 录音

正确答案：E。录音

解析：本题考查咨询技巧。录音（E错，为本题正确答案）不属于倾听的技巧。倾听时应做到全神贯注（A对），不随意打断服务对方的讲话（C对），不做无关的动作（B对），用非语言交流方式给予服务对象及时反馈（D对），边听边有所示意，表示尊重和理解。在倾听过程中准确领悟对方的感受，听毕及时做出反应，概括其需求和咨询目的，并提供针对性的信息，以帮助对象解决问题。